青春期保健要点不包括以下哪一项
A. 痤疮
B. 近视眼
C. 遗精
D. 经期保健
E. 手淫

正确答案：B。近视眼

解析：本题考查青春期保健要点。近视眼（B错，为本题正确答案）属于学龄期保健要点。青春期保健要点包括：①痤疮（A对）：症状严重者可在医生指导下进行药物治疗；②女性经期保健（D对）：这是保持生殖健康的必要措施；③男性遗精（C对）：首次遗精是男性性器官及性功能发育基本成熟的标志；④手淫（E对）：男女青少年均可发生。适度手淫对身体健康无不良影响,过度则可对身心健康造成不良影响；⑤重视心理卫生：此期青少年处于生理违拗期,要给予正确教育；⑥正确的性教育：结合生理卫生举办青春期卫生专题讲座，帮助其了解青春期的发育特点。